下列属于颅脑疾病感染性抽搐的是
A. 外伤
B. 脑挫伤
C. 脑积水
D. 脑寄生虫
E. 神经胶质瘤

正确答案：D。脑寄生虫

解析：抽搐一般可以由颅脑疾病、全身性疾病和功能性引起。其中颅脑疾病中感染性因素包括各种脑炎及脑膜炎、脑脓肿、脑寄生虫（D对）等。非感染性因素包括（1）外伤（A错）：产伤、脑挫伤（B错）、脑血肿；（2）肿瘤：原发性肿瘤（如脑膜瘤、神经胶质瘤（E错）等）及转移性脑肿瘤；（3）血管性疾病：脑血管畸形、高血压脑病、脑梗死、脑出血等；（4）癫痫；（5）先天异常及变性疾病：如脑发育不全、小头畸形、脑积水（C错）、结节性硬化、多发性硬化、核黄疸等。